大多数髁突骨折可采用
A. 保守治疗
B. 单颌固定
C. 颌间结扎
D. 切开复位内固定术
E. 暂不处理，随访

正确答案：A。保守治疗

解析：大多数髁突骨折可采用保守治疗，即在手法复位并恢复咬合关系后行颌间固定。对于翼外肌附着上方骨折而无移位者，可不作颌间固定，采用弹性吊颌帽限制下颌运动，保持正常咬合关系即可。掌握“牙槽突骨折、颌骨骨折”知识点。